发达国家人均脂肪摄入量与大肠癌发生率，均高于发展中国家，由此支持脂肪摄入量与大肠癌之间的因果关联，这一推理运用了因果判定标准中的
A. 关联的时间顺序
B. 暴露与疾病的分布一致
C. 关联的可重复性
D. 终止效应

正确答案：B。暴露与疾病的分布一致

解析：本题考查因果判定标准。发达国家人均脂肪摄入量与大肠癌发生率，均高于发展中国家，由此支持脂肪摄入量与大肠癌之间的因果关联，这一推理运用了因果判定标准中的暴露与疾病的分布一致（B对ACD错）。